IgG的生物学作用之一是
A. 与Ag结合后激活补体
B. 不能透过胎盘
C. 与Ag作用后，体内最先出现
D. 是分泌液中主要的保护性抗体
E. 参与Ⅰ型超敏反应

正确答案：A。与Ag结合后激活补体